男，50岁。呕血、黑便1天。乙肝病史20年。查体：P112次/分，BP85/55mmHg。可见蜘蛛痣、肝掌，结膜苍白，巩膜黄染。腹膨隆，腹壁静脉曲张，肝肋下未触及，脾肋下1cm，质软，移动性浊音（+）。该患者呕血、黑便最可能的原因是
A. 溃疡型胃癌
B. 急性胃炎
C. 慢性胃溃疡癌变
D. 应激性胃炎
E. 食管胃底静脉曲张破裂

正确答案：E。食管胃底静脉曲张破裂

解析：中老年男性患者。乙肝病史20年，呕血、黑便1天（上消化道出血典型临床表现）。查体：P112次/分（心率增快），BP85/55mmHg（提示休克）。蜘蛛痣、肝掌，结膜苍白，巩膜黄染（提示肝功减退），腹膨隆，脾肋下1cm，移动性浊音（+），腹壁静脉曲张（提示门静脉高压）。综合患者病史、临床表现，体征，最可能的诊断为1.肝硬化；2.食管胃底静脉曲张破裂（E对）。溃疡性胃癌（A错）患者早期无明显症状，进展期最常见的症状为体重减轻和上腹痛，另有贫血、食欲缺乏、厌食、乏力全身表现。胃镜病理检查可明确诊断。慢性胃溃疡癌变（D）患者疾病周期长，进展缓慢，早期表现为规律性上腹痛，晚期出现胃癌恶病质表现